红花药材的鉴别特征有
A. 不带子房的管状花
B. 花冠筒细长，先端5裂
C. 表面黄色或红色
D. 浸水中，水溶液呈红色
E. 质硬，刺手

正确答案：A、B、C。不带子房的管状花；花冠筒细长，先端5裂；表面黄色或红色

解析：本题考查的是红花药材的性状鉴别。红花药材的鉴别特征有不带子房的管状花（A对）、花冠筒细长，先端5裂（B对）与表面黄色或红色（C对）。红花：【性状鉴别】药材为不带子房的管状花。表面红黄色或红色。花冠筒细长，先端5裂，裂片呈狭条形；雄蕊5，花药聚合呈筒状，黄白色；柱头长圆柱形，顶端微分叉。质柔软。气微香，味微苦。浸水中，水溶液呈红色（D错）的是苏木。苏木碎片投入热水，水染成红色，加酸变成黄色，再加碱液，仍变成红色。鉴别特征为质硬，刺手（E错）的中药，2022年考试指南未明确说明。